能满足生产需要的最大休止角
A. 30度
B. 40度
C. 50度
D. 60度
E. 70度

正确答案：B。40度

解析：本题考查粉体休止角与粉体流动性的关系。一般认为休止角小于40°（B对）时粉体的流动性良好,可满足压片过程中对流动性的要求。